治疗脑血栓风痰瘀血，痹阻脉络证，应首选
A. 天麻钩藤汤
B. 真方白丸子
C. 补阳还五汤
D. 镇肝息风汤
E. 星萎承气汤

正确答案：B。真方白丸子

解析：真方白丸子可以祛风化痰通络，用于治疗脑血栓风痰瘀血，痹阻脉络证（B对）。天麻钩藤饮（A错）可平肝潜阳，活血通络，用于肝阳暴亢，风阳上扰型脑血栓。补阳还五汤（C错）可益气养血，化瘀通络，用于气虚血瘀型脑血栓。镇肝息风汤（D错）可滋阴潜阳，镇肝息风，用于肝肾阴虚，风阳上扰型脑血栓。星蒌承气汤（E错）可通腑泄热，化痰理气，用于痰热腑实，风痰上扰型脑血栓。